下列关于舌下神经的叙述中，正确的是
A. 经二腹肌后腹深面进入颈动脉三角
B. 舌肌（除腭舌肌外）全部由舌下神经支配
C. 舌下神经为运动神经
D. 呈弓形跨过颈内、外动脉的表面
E. 以上都正确

正确答案：E。以上都正确

解析：舌下神经：经二腹肌后腹深面进入颈动脉三角，呈弓形跨过颈内、外动脉的表面，于舌骨大角上方，再次经二腹肌后腹的深面进入下颌下三角。掌握“气管颈段、颈动脉三角的解剖特点及临床应用”知识点。